用于用药错误分级的是
A. NCCMERP标准
B. Cochrane分级
C. Cockroft-Gault公式
D. CLHD公式
E. Child-Turcotte-Pugh评分

正确答案：A。NCCMERP标准

解析：本题考查NCCMERP标准。用于用药错误分级的是NCCMERP标准（A对）。Cochrane分级（B错）用于循证医学评价证据强弱分级。Cockroft-Gault公式（C错）用于评估CHF患者肾功能与死亡率的关系。CLHD公式（D错）用于估算透析清除率。Child-Turcotte-Pugh评分(E错）用于评价终末期肝病肝脏储备功能的进展。